分布于小指的皮肤是
A. 正中神经
B. 尺神经
C. 正中神经和尺神经
D. 正中神经和桡神经
E. 桡神经

正确答案：B。尺神经

解析：尺神经（B对）的浅支分布于小鱼际表面的皮肤、小指掌面皮肤和环指尺侧半掌面皮肤。正中神经（ACD错）的感觉纤维则分布于桡侧半手掌、桡侧三个半手指掌面皮肤及其中节和远节指背皮肤。桡神经（DE错）的浅支分布于手背桡侧半皮肤和桡侧两个半手指近节背面的皮肤。